妊娠10周后，雌激素的主要来源是
A. 胎儿-胎盘单位
B. 胎儿肾上腺皮质
C. 子宫平滑肌
D. 胎盘合体滋养细胞
E. 卵巢黄体

正确答案：A。胎儿-胎盘单位

解析：雌激素早期由卵巢黄体（E错）产生，妊娠10周后，雌激素的主要来源是胎儿-胎盘单位（A对），即由胎儿、胎盘与母体相互协作合成。胎儿肾上腺皮质（B错）、胎盘合体滋养细胞（D错）均参与该合成过程。